5岁患儿，感冒痊愈后一周的白细胞值应为
A. N0.50 L0.45
B. N0.60 L0.35
C. N0.35 L0.60
D. N0.75 L0.20
E. N0.40 L0.55

正确答案：A。N0.50 L0.45

解析：5岁患儿的中性粒细胞与淋巴细胞比例相等，故答案选择A。